女，甲状腺肿大30年，近3年自觉压迫气管，2-3度肿大，行手术治疗，术后病理显示：大小结节，细胞大小不一，上皮扁平，滤泡细胞内充满胶质，如何治疗
A. 左甲状腺素长期服用
B. 糖皮质激素
C. 补充甲状腺激素
D. 氢化可的松静脉滴注
E. 头孢呋辛

正确答案：A。左甲状腺素长期服用

解析：女，甲状腺肿大30年，近3年自觉压迫气管，2-3度肿大，行手术治疗，术后病理显示：大小结节，细胞大小不一，上皮扁平，滤泡细胞内充满胶质（符合甲状腺滤泡型腺瘤（P306）中的胶样型腺瘤），本题为甲状腺滤泡型腺瘤中的胶样型腺瘤，甲状腺癌手术术后应用L-T4（A对）长期进行TSH抑制治疗能带来明显临床获益：①满足机体对甲状腺激素的生理需求；②甲状腺癌手术细胞表面表达TSH受体，对TSH刺激有反应，使用超生理剂量L-T4抑制血清TSH水平可以减少肿瘤复发风险。